女，72岁，摔倒后左肩部着地受伤，肩部肿胀，疼痛，肩关节活动障碍。X线片显示左侧肱骨外科颈骨皮质连续性中断，无明显移位，首选的治疗方法是
A. 三角巾悬吊贴胸位固定
B. 石膏外固定
C. 切开复位内固定
D. 小夹板外固定
E. 尺骨鹰嘴骨牵引+夹板固定

正确答案：A。三角巾悬吊贴胸位固定

解析：老年患者，左肩外伤，X线片示左侧肱骨外科颈骨皮质连续性中断，无明显移位，应诊断为左侧肱骨外科颈骨折，Neer一型（P633）。故患者首选的治疗方法是三角巾悬吊贴胸位固定（A对）。患者病情较轻，无切开复位内固定指征（C错）（多数移位的二部分以上的肱骨近端骨折采用切开复位钢板内固定）。石膏外固定（P622）（B错）适用于开放性骨折清创缝合术后、畸形矫正后矫形位置的维持等。小夹板外固定（P622）（D错）适用于四肢闭合性、无移位、稳定性骨折。尺骨鹰嘴骨牵引+夹板固定（E错）主要用于青壮年严重粉碎性骨折的治疗。